下列关于口腔境界的描述中，不恰当的一项是
A. 口腔前界为上下牙齿
B. 下以舌下区为界
C. 上界为腭
D. 牙列的舌侧部分为固有口腔
E. 牙列的唇颊侧部分为口腔前庭

正确答案：A。口腔前界为上下牙齿

解析：口腔前界为上下唇，后经由腭垂、腭舌弓和舌根共同组成的咽口通向口咽部，两侧为颊，上界为腭，下以舌下区为界。由上下牙列、牙龈和牙槽骨弓将口腔分为两部分，牙列的唇颊侧部分称为口腔前庭，牙列的舌侧部分称为固有口腔。掌握“口腔境界及唇、颊的局部解剖”知识点。